根呈不规则柱状，节处周围着生多数细长的根，气香，味微辛凉的药材是
A. 威灵仙
B. 白前
C. 白薇
D. 徐长卿
E. 秦艽

正确答案：D。徐长卿

解析：本题考查的是徐长卿药材的性状鉴别。根呈不规则柱状，节处周围着生多数细长的根，气香，味微辛凉的药材是徐长卿（D对）。徐长卿：【性状鉴别】药材根茎呈不规则柱状，有盘节。有的顶端带有残茎，细圆柱形，断面中空；根茎节处周围着生多数细长的根。根呈细长圆柱形，弯曲。表面淡黄白色至淡棕黄色或棕色；具微细的纵皱纹，并有纤细的须根。质脆，易折断，断面粉性，切断面皮部类白色或黄白色，形成层环淡棕色，木部细小。气香（含丹皮酚），味微辛凉。威灵仙（A错）：【性状鉴别】药材根茎呈柱状；表面淡棕黄色；顶端残留茎基；质较坚韧，断面纤维性；下侧着生多数细根。根呈细长圆柱形，稍弯曲；表面黑褐色，有细纵纹，有的皮部脱落，露出黄白色木部；质硬脆，易折断，断面皮部较广，木部淡黄色，略呈方形，皮部与木部常有裂隙。气微，味淡。白前（B错）：【性状鉴别】药材柳叶白前根茎呈细长圆柱形，有分枝，稍弯曲。表面黄白色或黄棕色，节明显，顶端有残茎。质脆，断面中空，习称“鹅管白前”。节处簇生纤细弯曲的根，有多次分枝呈毛须状，常盘曲成团。气微，味微甜。白薇（C错）：【性状鉴别】药材呈根茎粗短，有结节，多弯曲。上面有圆形的茎痕，下面及两侧簇生多数细长的根。表面棕黄色。质脆，易折断，断面皮部黄白色，木部黄色。气微，味微苦。秦艽（E错）：【性状鉴别】药材呈类圆柱形，上粗下细，扭曲不直。表面黄棕色或灰黄色，有纵向或扭曲的纵皱纹，顶端有残存的茎基及纤维状叶鞘。质硬而脆，易折断，切断面略显油性，皮部黄色或棕黄色，木部黄色。气特异，味苦、微涩。